初产妇，25岁。妊娠39周，临产后产程进展顺利，胎头拨露时，胎心110次/分，应采取什么措施
A. 点滴稀释缩宫素
B. 立即剖宫产
C. 吸氧等待自然分娩
D. 会阴侧切，胎头吸引分娩
E. 用胎儿监护仪器检测是否缺氧

正确答案：C。吸氧等待自然分娩

解析：青年初产妇，妊娠39周（妊娠28周及以后为妊娠晚期），胎头拨露（说明已进入第二产程），胎心率110次/分（八版妇产科学正常值120～160次/分，提示胎心率偏低），应加快第二产程，应采取会阴侧切（D对），所以原答案为D。现应根据九版教材胎心无异常，吸氧等待自然分娩（C对）。点滴稀释缩宫素（P189）（A错）适用于协调性宫缩乏力或使不协调宫缩乏力恢复协调性。立即剖宫产（B错）适用于产程无进展、胎儿窘迫、头盆不称等情况时。